与少量水共研，形成黄白色乳状液的中药材是
A. 没药
B. 血竭
C. 乳香
D. 儿茶
E. 五倍子

正确答案：C。乳香

解析：本题考查乳香的性状鉴别。与少量水共研，形成黄白色乳状液的中药材是乳香（C对）。乳香【性状鉴别】以颗粒状、半透明、色黄白、无杂质、气芳香者为佳。本品燃烧时显油性，冒黑烟，有香气；加水研磨成白色或黄白色乳状液。没药（A错）【性状鉴别】以块大、色黄棕、半透明、香气浓而持久、无杂质者为佳。血竭（B错）【性状鉴别】本品粉末，置白纸上，用火隔纸烘烤即熔化，但无扩散的油迹，对光照视呈鲜艳的红色。以火燃烧则产生呛鼻的烟气。儿茶（D错）【性状鉴别】药材呈方形或不规则块状，大小不一。表面棕褐色或黑褐色，光滑而稍具光泽。质硬，易碎，断面不整齐，具光泽，有细孔，遇潮有黏性。气微，味涩、苦，略回甜。取火柴杆浸于本品水浸液中，使轻微着色，待干燥后，再浸入盐酸中立即取出，置火焰附近烘烤，杆上即显深红色。五倍子（E错）【性状鉴别】饮片呈不规则碎片状。表面灰褐色或灰棕色，微有柔毛，内壁光滑，外表面有麻点状突起或明暗相间的纵向纹理。质硬而脆，断面角质样，有光泽。气特异，味涩。